以下关于嵌体蜡型的说法哪项是错误的
A. 材料有铸造蜡、塑料蜡及自凝塑料
B. 可采用直接法、间接法和间接直接法
C. 双面嵌体铸道应安插在蜡型的牙尖处
D. 蜡型表面光滑
E. 以上都不是

正确答案：C。双面嵌体铸道应安插在蜡型的牙尖处

解析：本题考查嵌体蜡型。铸道的放置一般放在蜡型最厚处，对于双面嵌体，应该放在两面的交界处，而不是蜡型的牙尖处（C错，为本题的正确答案），铸道放置在两面交界处不易形成缺损区，也可减少破坏精细雕刻的牙合面外形和咬合接触的可能。嵌体蜡型的材料包括铸造蜡、塑料蜡和自凝塑料（A对）。在制作嵌体蜡型时可采用直接法、间接法或间接直接法（B对），直接法简单方便，间接法制作的蜡型较为精确。蜡型的表面应尽量光滑，以使铸造出的嵌体表面光滑（D对）、精确、适合性好。